两下肢软瘫,腱反射消失,所有感觉消失,排尿排便障碍,可能由于
A. 两侧中央前、后回上半部损害
B. 马尾横断
C. 胸12横断
D. 两侧大脑前动脉栓塞
E. 颈7横断

正确答案：B。马尾横断

解析：马尾由骶、尾部的脊神经根在穿经相应椎间孔合成，所以马尾横断（B对）导致两下肢软瘫,腱反射消失,所有感觉消失,排尿排便障碍。